既能祛风湿，又能消骨骾的药物是
A. 威灵仙
B. 防己
C. 狗脊
D. 独活
E. 木瓜

正确答案：A。威灵仙

解析：威灵仙辛散温通，味咸兼软，走窜力强，入膀胱经。善祛风湿、通经络、止痹痛，为治痹痛拘挛麻木之要药。能软化骾骨、消痰水，治诸骨骾喉及痰饮积聚可投。（A对）。防己（B错）功效祛风止痛，利水消肿。狗脊（C错）功效祛风湿，补肝肾，强腰膝。独活（D错）祛风除湿，通痹止痛，解表。木瓜（E错）舒筋活络，和胃化湿。